减鼻充血药通常用于缓解鼻塞症状，其所激动的受体是
A. M受体
B. N受体
C. H₁受体
D. α受体
E. β受体

正确答案：D。α受体

解析：本题考查减鼻充血药的药理作用。减鼻充血药通常用于缓解鼻塞症状，其所激动的受体是α受体（D对）。减鼻充血药是α受体激动剂，可对鼻甲中的容量血管产生收缩作用，通过减少鼻黏膜中的血流而缓解鼻塞症状。减鼻充血药起效迅速，喷雾剂的药物分布效果强于滴鼻剂。